患者，男，55岁。劳累及情绪激动后，多次出现短时间胸骨后疼痛，下列哪项血清检查对明确诊断最有参考意义
A. 钾
B. 钠
C. 氯化物
D. 钙
E. 胆固醇及甘油三脂

正确答案：E。胆固醇及甘油三脂